毒性的上限指标有
A. 绝对致死量，最大耐受量，最大无作用剂量，最小致死量
B. 绝对致死量，最大耐受量，半数致死量，最小致死量
C. 绝对致死量，最大无作用剂量，阈剂量，半数耐受剂量
D. 绝对致死量，阈剂量，最大耐受量，最小致死量

正确答案：B。绝对致死量，最大耐受量，半数致死量，最小致死量

解析：本题考查毒性的上限指标。毒性是指在特定条件下，化学物导致机体有害作用的一种内在的、固有的能力。毒性上限参数是在急性毒性试验中以死亡为观察效应终点的各项毒性参数。毒性的上限指标有绝对致死量，最大耐受量，半数致死量，最小致死量（B对ACD错）。